上述各项，属灭菌法的是
A. 电离辐射
B. 紫外线
C. 超声波
D. 洗手
E. 碘类消毒

正确答案：A。电离辐射

解析：灭菌法可杀灭一切微生物，如热力灭菌、电离辐射（A对）、微波等物理消毒法，化学消毒剂，如醛类、环氧乙烷、过氧化氢、过氧乙酸等。